具有凉血化瘀止血作用，用于血热有瘀之出血的饮片是
A. 当归炭
B. 生地炭
C. 黄柏炭
D. 熟地炭
E. 大黄炭

正确答案：E。大黄炭

解析：本题考查大黄的炮制作用。大黄【炮制作用】大黄炭（E对）泻下作用极微，有凉血化瘀止血作用。用于血热有瘀之出血。当归【炮制作用】当归炭（A错），具有止血和血作用。用于崩中漏下，月经过多。生地【炮制作用】生地炭（B错）入血分凉血止血，用于吐血，衄血，尿血，便血，崩漏等。黄柏【炮制作用】黄柏炭（C错）清湿热之中兼具涩性，多用于便血、崩漏下血。熟地【炮制作用】熟地炭（D错）以补血止血为主，用于虚损性出血。